司舌下腺分泌的核有
A. 舌下神经核
B. 上泌涎核
C. 面神经核
D. 红核
E. 三叉神经脊束核

正确答案：B。上泌涎核

解析：上泌涎核（B对）副交感神经节后纤维司舌下腺分泌；舌下神经核（A错）发出一般躯体运动纤维组成舌下神经，支配舌内、外肌的随意运动；面神经核（C错）发出的纤维支配表情肌；红核（D错）主要兴奋屈肌运动神经元，同时抑制伸肌运动神经元；三叉神经脊束核（E错）主要接受三叉神经内传递头面部痛、温觉的初级感觉纤维； 下部还接受来自面神经、舌咽神经和迷走神经的一般躯体感觉纤维。